关于治疗霍乱补液原则下列哪项是错误的
A. 静脉补液以5：4：1溶液为主
B. 轻、中型脱水者可予以口服补液
C. 重型脱水者应积极补钾
D. 中型脱水者24小时补液量为4000～8000mL
E. 重型脱水者治疗应早期快速静脉补液

正确答案：C。重型脱水者应积极补钾

解析：对于重度脱水、不能口服的中度脱水及极少数轻度脱水患者，宜静脉补液。补液原则是：早期、迅速、足量，先盐后糖，先快后慢，纠酸补钙，见尿补钾，所以重型脱水者应积极补钾（C错，为本题正确答案）错误；静脉补液通常选择与患者丧失电解质浓度相似的541溶液（每升含氯化钠5g，碳酸氢钠4g和氯化钠1g）（A对）；霍乱患者肠道对葡萄糖的吸收能力仍然完好，葡萄糖的吸收能带动水及钠、钾等电解质的吸收。轻、中型脱水患者可予口服补液（B对），重度脱水患者在纠正低血容量性休克后，也可给予口服补液。静脉补液输液量和速度宜根据失水程度决定。以第一个24小时计，中型脱水者24小时补液量为4000～8000mL（D对）。重型脱水者治疗应早期快速补液（E对），输入2000～4000mL液体，为此需建立多条输液通路和∕或加压输液装置以保证输入量及速度每分钟1mL∕kg，视情况改善，逐步减慢速度。